门脉高压所致的腹壁静脉曲张，在下列哪个部位可闻及血管杂音
A. 脐周
B. 上腹部
C. 下腹部
D. 左侧腹部
E. 右侧腹部

正确答案：A。脐周

解析：门脉高压症是指由门静脉系统压力升高所引起的一系列临床表现，是一个临床病症，为各种原因所致门静脉血循环障碍的临床综合表现，常可导致腹壁静脉曲张（以脐为中心向四周伸展的一簇曲张的腹壁静脉，如水母头状，常提示肝硬化所致门静脉高压侧支循环形成），用听诊器听诊可闻及静脉性杂音，次杂音为连续的嗡鸣音，此音多于脐周（A对CDE错）或上腹部出现。注：此题并不严谨，因为上腹部（B对）也可以闻及血管杂音，但是最多见的还是脐周。